有清骨蒸潮热作用的方剂是
A. 清骨散
B. 知柏地黄丸
C. 清营汤
D. 黄连解毒汤
E. 五味消毒饮

正确答案：A。清骨散

解析：本题考查方剂的功用，属于记忆理解内容。清骨散功用清虚热，退骨蒸（A对）。知柏地黄丸功用滋阴降火（B错）。清营汤功用清营解毒，透热养阴（C错）。黄连解毒汤功用泻火解毒（D错）。五味消毒饮功用清热解毒，消散疔疮（E错）。